在体内代谢产生醌类物质，可与蛋白发生共价键结合，产生毒性而撤市的药物是
A. 阿司咪唑
B. 丙米嗪
C. 文拉法辛
D. 普拉洛尔
E. 尼卡地平

正确答案：D。普拉洛尔

解析：本题考查药物与体内代谢过程引发的毒副作用。药物在体内发生代谢作用，生成有反应活性的物质，引发毒性作用，这类毒性被称作特质性药物毒性。普拉洛尔（D对）在体内的代谢活化首先发生O-去烷基化生成化合物（对乙酰氨基酚），继之氧化生成亚胺-醌式结构化合物，该代谢活化产物可与蛋白发生不可逆结合生成产物，后者可导致临床上发生特质性硬化性腹膜炎，普拉洛尔由此而被撤出市场。